下列关于颌骨骨髓炎慢性期特点的描述，除外
A. 体温升高、发热、寒战
B. 全身症状较轻
C. 全身消瘦、贫血
D. 机体慢性中毒消耗症状
E. 口腔内或面颊部可出现多个瘘孔

正确答案：A。体温升高、发热、寒战

解析：颌骨骨髓炎慢性期的特点：全身症状轻。体温正常或仅有低热；全身消瘦、贫血，机体慢性中毒消耗症状。病情发展缓慢，局部肿胀，皮肤微红、口腔内或面颊部可出现多个瘘孔溢脓。肿胀区牙松动。掌握“颌骨骨髓炎”知识点。